下列关于可能引起类风湿关节炎的感染因子中，通过活化B淋巴细胞而致病的是
A. EB病毒
B. 支原体
C. 大肠埃希菌
D. 链球菌
E. 柯萨奇病毒

正确答案：A。EB病毒

解析：类风湿关节炎的发病因素中，环境因素也是RA 发病的重要因素，许多病原体与RA发病有关，支原体、EB病毒、细小病毒B19、风疹病毒、结核杆菌、逆转录病毒等病原体都被认为可能是RA的病因，其中EB病毒可选择性感染B细胞有关，通过活化B淋巴细胞而致病（E对）。